患者，男，45岁。初始诊断肾病综合合并严重肝功能不全，宜选用的糖皮质激素是
A. 氟替卡松
B. 泼尼松
C. 可的松
D. 泼尼松龙
E. 布地奈德

正确答案：D。泼尼松龙

解析：本题考查泼尼松龙。该患者诊断为肾病综合征合并严重肝功能不全，宜选用泼尼松龙（D对）进行治疗。可的松（C错）和泼尼松（B错）为前药，需在肝内分别转化为氢化可的松和泼尼松龙而生效，故严重肝功能不全者宜选择氢化可的松或泼尼松龙。氟替卡松（A错）用于预防和治疗季节性过敏性鼻炎（包括枯草热）及常年性过敏性鼻炎，用于成人的各种皮质激素可缓解的炎症性和瘙痒性皮肤病。布地奈德（E错）用于非糖皮质激素依赖性或依赖性的支气管哮喘和哮喘性慢性支气管炎患者。